脾动脉的供养范围包括
A. 胃、肝、脾
B. 胃、脾、胰
C. 胰和脾
D. 胃、十二指肠和脾
E. 胃和脾

正确答案：B。胃、脾、胰

解析：胃、脾、胰（B对）为脾动脉的供养范围。其中胃后动脉、胃短动脉营养胃底，胃网膜左动脉分布于胃大弯左侧的胃壁和胃网膜，胰支分布于胰体和胰尾，脾支发布于脾。